可出现血液中抗壁细胞抗体阳性的疾病是
A. 慢性非萎缩性胃炎
B. 急性胃炎
C. 慢性萎缩性胃炎
D. 反流性食管炎
E. 十二指肠溃疡

正确答案：C。慢性萎缩性胃炎

解析：慢性胃炎（P210）按照内镜和病理诊断可分为慢性非萎缩性胃炎和慢性萎缩性胃炎，前者又称慢性单纯性胃炎，是胃粘膜最常见病变之一，镜下主要表现为黏膜浅层固有膜慢性炎细胞浸润，但腺体保持完整无萎缩（A错）；后者以胃黏膜萎缩变薄，粘膜腺体减少或消失并伴有肠上皮化生，固有层内多量炎性细胞浸润为特点。本病病因复杂，据发病是否与自身免疫有关分为A、B型，A型为自身免疫型，系血液中抗壁细胞抗体存在（C对）。壁细胞可分泌的内因子可于B12结合，使之不被消化酶吸收而到达回肠被吸收。A型慢性萎缩性胃炎患者因体内存在抗壁细胞抗体，不仅胃酸分泌减少，且因B12吸收障碍导致巨幼红细胞贫血，为恶性贫血。急性胃炎（P210）（B错）为常由理化因素及病原生物感染引起的急性胃粘膜如充血、水肿、糜烂、溃疡等病变。反流性食管炎（P208）（D错）系胃液反流至食管，引起食管下粘膜炎性病变。十二指肠溃疡（P212）（E错）是与多种因素可能相关，如幽门螺旋杆菌感染、粘膜自身抗消化能力减弱（长期服用非固醇类抗炎药）、神经内分泌功能失调、遗传等，以十二指肠粘膜形成慢性溃疡为特征的疾病，病理切片可见分泌胃酸的壁细胞总数明显增多，造成胃酸分泌增加，与题干相反。